疳肿胀的治法是
A. 利水消肿
B. 淡渗利湿
C. 温阳利水
D. 健脾化湿
E. 疏风利水

正确答案：C。温阳利水

解析：疳肿胀可见脾肾阳虚所致足踝浮肿，甚或颜面及全身浮肿等症状，故治宜温阳利水（C对）。利水消肿，只是治标，少了治本的温阳（A错）。淡渗利湿用于水湿壅盛所致的泄泻清稀、小便不利、水肿、舌苔白、脉濡等症（B错）。健脾化湿用于脾虚湿困，对于本证少了利水,难以消肿（D错）。疏风利水，本病非风水相搏所致，故不需疏风（E错）。